本条例适用于下列实验室及其从事实验活动的生物安全管理，但不包括
A. 中国境内的
B. 中国境外的
C. 中国人民解放军的
D. 农业部所属的
E. 卫健委所属的

正确答案：B。中国境外的